患者，男性，37岁。在心脏手术过程中，病人心电图表明：突然发生三度房室传导阻滞。此时该用何药做紧急处置
A. 静注阿托品
B. 静滴异丙肾上腺素
C. 静注肾上腺素
D. 静滴山莨菪碱
E. 静滴去甲上肾腺素

正确答案：B。静滴异丙肾上腺素